先天性甲状腺功能减退症常见于
A. 早产儿
B. 足月儿
C. 小于胎龄儿
D. 过期产儿
E. 低出生体重儿

正确答案：D。过期产儿

解析：先天性甲状腺功能减退症是由于甲状腺激素合成不足或其受体缺陷所致的一种疾病，其常见于过期产儿（D对）。